依照《中华人民共和国药品管理法实施条例》，接受委托生产药品的药品生产企业，必须持有与其受托生产的药品相适应的
A. 《药品生产质量管理规范》认证证书
B. 《药品生产卫生许可证》
C. 药品批准文号
D. 《受托生产药品许可证》
E. 《药品生产合格证》

正确答案：A。《药品生产质量管理规范》认证证书